足月儿开始添加米粉的时间是
A. 出生后10～12个月
B. 出生后2个月
C. 出生后4～6个月
D. 出生后7～9个月
E. 出生后2周

正确答案：C。出生后4～6个月

解析：足月儿开始添加米粉的时间是出生后4～6个月（C对）。出生后10～12个月（A错）开始添加软饭、配方奶碎肉、碎菜、蛋、鱼肉、豆制品、水果。出生后2个月（B错）开始添加新鲜果汁如桔汁、西红柿汁等。出生后7～9个月（D错）开始添加稀（软饭）、配方奶、肉末、菜末、蛋、鱼泥、豆腐、水果。出生后2周（E错）开始添加维生素D。